男，48岁。因右胫骨平台骨折术后软组织感染1月余入院治疗。骨科主治医师王某建议进行专家会诊。会诊后决定采用保守治疗，既避免手术治疗造成软组织的进—步损伤，又能节约费用。治疗期间患者经常出现紧张、焦虑，害怕出现组织坏死甚至截肢等严重后果，影响睡眠和康复。骨科主治医师应当对患者实施的医学措施是
A. 精神障碍治疗
B. 心理健康指导
C. 精神障碍鉴定
D. 精神障碍诊断
E. 精神障碍检查

正确答案：B。心理健康指导

解析：患者治疗期间出现紧张、焦虑，症状较轻，应当对患者进行心理健康指导（B对）。